苔白，脉迟。治疗除取主穴外，还应加
A. 上脘、胃俞
B. 肝俞、太冲
C. 肾俞、太溪
D. 胆俞、丘墟
E. 次髎、血海

正确答案：A。上脘、胃俞

解析：该患者以呕吐清水、胃部不适为主证，可诊断为胃痛、呕吐。食久乃吐、喜热畏寒、身倦、便溏、小便少、舌苔白、脉迟均为寒邪客胃之象，辨证为呕吐寒邪客胃证。上脘降逆止呕，胃俞为胃之背俞穴，专治胃疾，二者合用，降逆止呕和胃（A对）。肝俞配合太冲主要治疗肝经风热病证（B错）；肾俞、太溪合用用于治疗肾虚诸证（C错）；胆俞、丘墟配合用于肝胆病证（D错）；次髎、血海合用用于月经不调、痛经等妇科疾患（E错）。